将一群未患病的人根据是否暴露于所研究的病因或暴露程度而划分不同组别，然后在一定期间内随访观察不同组别的该病的发病（死亡）率，以评价暴露与疾病的关系，这种方法是
A. 生态学研究
B. 病例对照研究
C. 队列研究
D. 历史性队列研究
E. 筛查

正确答案：C。队列研究

解析：本题考查队列研究的概念。队列研究（C对ABDE错）是将人群按是否暴露于某可疑因素及其暴露程度分为不同组，追踪其各组的结局，比较不同组之间结局频率的差异，从而判定暴露因素与结局之间有无因果关联及关联大小的一种观察性研究方法。